下列分析方法中，不属于药物经济学评价方法的是
A. 最小成本分析法
B. 成本-效应分析法
C. 成本-效用分析法
D. 成本-效益分析法
E. 成本-效果分析法

正确答案：B。成本-效应分析法

解析：本题考查药物经济学评价方法。不属于药物经济学评价方法的是成本-效应分析法（B错，为本题正确答案）。药物经济学评价方法有：①最小成本分析（A对）；②成本-效用分析（C对）；③成本-效益分析（D对）；④成本-效果分析（E对）。